主要用于评价吸收速度快慢的是
A. Tmax
B. 波动度
C. 绝对生物利用度
D. Css
E. 相对生物利用度

正确答案：A。Tmax

解析：本题考查主要用于评价吸收速度快慢的参数。主要用于评价吸收速度快慢的是Tmax（A对）。